青少年牙周炎临床表现不包括
A. 发病年龄从青春期至25岁多见
B. 牙石刺激及牙龈炎症明显
C. 牙齿移位明显
D. 牙齿松动明显
E. 邻面有较深的牙周袋

正确答案：B。牙石刺激及牙龈炎症明显

解析：本题考查局限型侵袭性牙周炎的临床表现。青少年牙周炎临床表现不包括牙石刺激及牙龈炎症明显（B错，为本题的正确答案）。青少年牙周炎又称侵袭性牙周炎，其临床表现有发病年龄较早一般开始于青春期前后至25岁多见（A对）。牙周破坏程度与局部刺激物的量不成比例，患者菌斑牙石少，牙龈表面的炎症轻微，但已有邻面深牙周袋（E对）和牙槽骨破坏。早期由于牙槽骨吸收就出现牙齿松动（C对）和牙齿移动（D对），在炎症不明显的情况下，切牙出现扇形移位。